45岁男性，经理，送来急诊，自述半小时前突然感到气紧，胸闷，心悸，头晕，出汗，认为生命垂危，要求紧急处理。近一月来，这种情况发生过3次，每次持续约0.5～1小时，发病间隙期一切正常，发病与饮食无明显关系。最有助于鉴别诊断的项目是
A. 追问起病诱因
B. 心电图
C. 脑电图
D. 血钾测定
E. 脑CT

正确答案：B。心电图

解析：该病例患者突然感到气紧以及认为生命垂危（惊恐发作表现），发作时有胸闷、心悸、头晕，出汗（自主神经症状），近一月来，反复发作，持续时间0.5-1小时（一个月之内存在数次惊恐发作，发作时间一般数分钟至数十分钟），故诊断为惊恐发作，本例患者有胸闷、心悸的表现，故需进行心电图以排除心血管疾病（B对）。